在四季分明的温带地区，大骨节病临床症状最明显的季节是
A. 春季
B. 夏季
C. 秋季
D. 冬季
E. 秋冬之交

正确答案：A。春季

解析：本题考查大骨节病临床症状最明显的季节。大骨节病是一种地方性、慢性骨关节变形性疾病，以四肢关节软骨和骺板软骨变性坏死、增生、修复为主要病理改变，以骨关节增粗、畸形、强直、肌肉萎缩、运动障碍为主要临床表现。在四季分明的温带地区，大骨节病临床症状最明显的季节是春季（A对BCDE错）。